关于流行病学研究内容的描述不正确的是
A. 是以传染病为主的研究内容发展起来的
B. 目前扩大到全面的疾病和健康状态
C. 包括疾病、伤害和健康三个层次
D. 疾病包括传染病、寄生虫病、地方病和非传染性疾病
E. 健康是指无病和虚弱

正确答案：E。健康是指无病和虚弱

解析：本题考查流行病学研究内容。流行病学是从以传染病为主的研究内容发展起来的（A对），目前已扩大到全面的疾病和健康状态（B对），包括了疾病、伤害和健康三个层次（C对）。疾病包括传染病、寄生虫病、地方病和非传染性疾病等所有疾病（D对）。伤害包括意外、残疾、智障和身心损害等。健康是指身体健康、精神和社会适应各方面均处于完好状态，而不只是无病或虚弱（E错，为本题正确答案）。